上市后开发新适应证为抗心律失常的药物是
A. 利多卡因
B. 阿司匹林
C. 后马托品
D. 异丙嗪
E. 金刚烷胺

正确答案：A。利多卡因

解析：本题考查利多卡因。利多卡因（A对）是上市后开发新适应证为抗心律失常的药物。阿司匹林（B错）为解热镇痛药，临床用于感冒、发热及中等程度疼痛的治疗。后马托品（C错）用于眼科检查验光，临床用于散瞳。异丙嗪（D错）为抗组胺药物，主要适用于各种类型的过敏。金刚烷胺（E错）为抗病毒药，同时还对帕金森病有治疗作用。